西咪替丁结构中含有
A. 呋喃环
B. 噻唑环
C. 噻吩环
D. 咪唑环
E. 吡啶环

正确答案：D。咪唑环

解析：本题考查西咪替丁。西咪替丁是可选择性H2受体拮抗剂，用于消化性溃疡的治疗，结构中含咪唑环（D对）。含呋喃环（A错）的有雷尼替丁，含噻唑环（B错）的有法莫替丁，噻吩环（C错）不存在于组胺H2受体阻断剂中。含吡啶环（E错）的有奥美拉唑。